根据《中国药典》“凡例”，下列对中药［贮藏］项下的各名词术语的解释，正确的是
A. 阴凉处，系指不超过18℃的环境
B. 凉暗处，系指避光并不超过18℃的环境
C. 常温，系指10～30℃的环境
D. 冷处，系指5～10℃的环境
E. 室温，系指20～30℃的环境

正确答案：C。常温，系指10～30℃的环境

解析：本题考查的是《中国药典》“凡例”［贮藏］项下对各名词术语的规定。根据《中国药典》“凡例”，下列对中药［贮藏］项下的各名词术语的解释，正确的是常温，系指10～30℃的环境（C对）。《中华人民共和国药典》简称《中国药典》，是国家监督管理药品质量的法定技术标准。在《中国药典》“凡例”中，对中药［贮藏］项下的各名词术语进行了详细的解释。［贮藏］项下的规定，系对药品贮藏与保管的基本要求，除矿物药应置干燥洁净处不作具体规定外，一般以下列名词术语表示。（1）遮光：系指用不透光的容器包装，例如棕色容器或黑色包装材料包裹的无色透明、半透明容器。（2）密闭：系指将容器密闭，以防止尘土及异物进入。（3）密封：系指将容器密封，以防止风化、吸潮、挥发或异物进入。（4）熔封或严封：系指将容器熔封或用适宜的材料严封，以防止空气和水分的侵入并防止污染。（5）阴凉处：系指不超过20℃的环境（A错）。（6）凉暗处：系指避光并不超过20℃的环境（B错）。（7）冷处：系指2～10℃的环境（D错）。（8）常温：系指10～30℃的环境（E错）。除另有规定外，［贮藏］项未规定贮存温度的一般系指常温。